《中华人民共和国食品安全法》规定，负责对食品安全实施监督管理的国家部门是
A. 国务院农业行政部门
B. 国务院卫生行政部门
C. 国务院质量监督部门
D. 国务院工商行政管理部门
E. 国家食品药品监督管理部门

正确答案：E。国家食品药品监督管理部门

解析：本题考查《中华人民共和国食品安全法》规定，负责对食品安全实施监督管理的国家部门。《中华人民共和国食品安全法》规定，负责对食品安全实施监督管理的国家部门是国家食品药品监督管理部门（E对ABCD错）。